阿托品中毒时可用下列何药治疗
A. 毛果芸香碱
B. 酚妥拉明
C. 东莨菪碱
D. 后马托品
E. 山莨菪碱

正确答案：A。毛果芸香碱